四环素类抗生素与氢氧化铝或硫酸亚铁同服的相互作用属于
A. 物理学变化
B. 化学变化
C. 药效学变化
D. 药动学变化
E. 微生物学变化

正确答案：B。化学变化